牙龈肥大的临床特征
A. 牙龈呈深红或暗红色
B. 牙龈松软发炎，表面光滑
C. 龈缘肥厚
D. 龈乳头呈球状，常覆盖牙冠近牙颈1/3或更多，探之易出血
E. 以上都对

正确答案：E。以上都对

解析：本题考查牙龈肥大的临床特征。牙龈肥大的病因有多种，临床表现多以龈缘、龈乳头肥厚（C对），有的可波及附着龈。病因可有炎症性肥大、青春期龈炎、妊娠期龈炎、白血病的牙龈病损、药物性牙龈肥大、牙龈纤维瘤病。妊娠期龈炎，可有牙龈呈深红或暗红色的临床特征（A对），牙龈松软发炎，表面光滑（B对）。白血病的牙龈病损可表现为龈乳头呈球状，常覆盖牙冠近牙颈1/3或更多，容易出血（D对），（ABCD均对，故E为本题的正确答案）。